喹诺酮类
A. 抑制细菌细胞壁合成
B. 抑制细菌蛋白质合成
C. 抑制细菌DNA依赖的RNA多聚酶
D. 抑制细菌二氢叶酸还原酶
E. 抑制细菌DNA合成

正确答案：E。抑制细菌DNA合成

解析：DNA回旋酶的功能是使细菌恢复负超螺旋结构，便于装配到尺度更小的细菌细胞中去，而喹诺酮类抗生素主要的抗菌机制是作用于DNA回旋酶A亚基（主要是革兰氏阴性菌），通过抑制其切口和封口功能而阻碍细菌DNA合成（E对），最终导致细胞死亡。抑制细菌细胞壁合成（A错）是青霉素类抗生素的作用机制。抑制细菌蛋白质合成（B错）为氨基糖苷类抗生素的作用机制。抑制细菌DNA依赖的RNA多聚酶（C错）为利福霉素类抗生素的作用机制。抑制细菌二氢叶酸还原酶（D错）为磺胺类药物的抗菌机制。